在诊治护理过程中，不使患者受到身心损害的是
A. 无伤原则
B. 行善原则
C. 公正原则
D. 尊重原则
E. 平等原则

正确答案：A。无伤原则

解析：无伤原则就是不伤害原则。不伤害原则要求医务人员在诊治过程中，应尽量避免对患者造成生理上和心理上的伤害更不能人为有意地制造伤害（A对E错）。有利原则要求医务人员的诊治行为应该保护患者利益、促进患者健康、增进其幸福。有利原则也称为行善原则（B错）。公正原则，要求医务人员合理分配和实现人们的医疗和健康利益（C错）。知情同意、知情选择、要求保守秘密和隐私等均是尊重患者的体现。广义上的尊重原则还包括医务人员尊重患者及其家属的人格（D错）。